某女，62岁。胸痛，痛有定处，伴有胸闷；舌紫暗苔白，脉弦。诊断为胸痹，证属气滞血瘀，给予复方丹参滴丸，一次15丸，一日3次，口服，连续服用4周。执业药师审核此处方，应指出的问题是
A. 给药剂量失准，单次剂量偏大
B. 选用药物不适宜
C. 给药途径不适宜，应为舌下含服
D. 给药频次失准，应为一日2次
E. 疗程不适宜，用药时间过长

正确答案：A。给药剂量失准，单次剂量偏大

解析：本题考查复方丹参滴丸的用法用量。结合患者症状为胸痹之气滞血瘀证。执业药师审核此处方，应指出的问题是给药剂量失准，单次剂量偏大（A对）。胸痹之气滞血瘀证【症状】心胸疼痛，如刺如绞，痛有定处，入夜为甚，重者心痛彻背，背痛彻心，或痛引肩背，伴有胸闷，日久不愈，可因暴怒、劳累而加重。舌质紫暗，有瘀斑，苔薄，脉弦细。【中成药应用】常用中成药为血府逐瘀口服液、速效救心丸、复方丹参滴丸（B错）。复方丹参滴丸【用法用量】口服或舌下含服（C错）。一次10丸，一日3次（D错），4周为一个疗程（E错）。不合理用药的主要表现：合理用药涉及的面很广，从药物的适应病证、剂型、剂量、用法、服用时间及配伍应用，到使用者的性别、年龄、体质及病情的变化等，无不密切相关。临床上经常出现不合理用药的案例，概括起来主要有以下几种。1.辨析病证不准确，用药指征不明确。2.给药剂量失准，用量过大或过小。3.疗程长短失宜，用药时间过长或过短。4.给药途径不适，未选择最佳给药途径。5.服用时间不当，不利于药物的药效发挥。6.违反用药禁忌，有悖于明令规定的配伍禁忌、妊娠禁忌、证候禁忌及服药时的饮食禁忌。7.同类重复使用，因对药物的性能不熟，或单纯追求经济效益，导致同类药重复使用。8.乱用贵重药品，因盲目自行购用，或追求经济效益，导致滥用贵重药品。